脱疽血脉瘀阻证的治法宜选用
A. 温阳散寒，活血通络
B. 活血化瘀，通络止痛
C. 清热利湿，解毒活血
D. 清热解毒，养阴活血
E. 活血化瘀，益气养阴

正确答案：B。活血化瘀，通络止痛

解析：血脉瘀阻证证候表现为：患趾（指）酸胀疼痛加重，夜难入寐，步履艰难，患趾（指）皮色暗红或紫暗，下垂更甚，皮肤发凉干燥，肌肉萎缩，趺阳脉搏动消失；舌暗红或有瘀斑，苔薄白，脉弦涩。证候表现无明显的热像，不需清热（C、D错），无明显寒像，皮肤发凉是因为瘀血阻滞经络，气血运行不畅，无需温阳散寒，只需活血通络即可（A错）；气阴两虚常见于热性病过程中，热在气分，汗出不彻，久而伤及气阴；或热盛耗伤津液，气随液脱；或温热病后期及内伤杂病，真阴亏损，元气大伤。也可见于某些慢性消耗性疾病。症见口渴、气短等（E错），以瘀血为主，治当活血化瘀，通络止痛（B对）。